心主神志最主要的物质基础是
A. 津液
B. 精液
C. 血液
D. 宗气
E. 营气

正确答案：C。血液

解析：本题考查心主神志最主要的物质基础，属于理解记忆内容。心主血脉，主藏神，只有心血充足才能化神养神而使心神灵敏不惑，所以血液是心主神志最主要的物质基础（C对）。